对G-菌的作用弱的
A. 第一代头孢菌
B. 第二代头孢菌
C. 第三代头孢菌
D. 青霉素类
E. 红霉素

正确答案：A。第一代头孢菌

解析：第一代头孢菌素对G+菌抗菌作用较第二、第三代强，但对G-菌的作用弱。可被细菌产生的β-内酰胺酶所破坏。主要用于治疗敏感菌所致呼吸道和尿路感染、皮肤及软组织感染。掌握“青霉素及头孢菌素类药”知识点。